根据《药品经营质量管理规范》，药品批发经营企业对所有的库存产品
A. 进行质量评审
B. 进行质量鉴定
C. 进行合法性审核
D. 实行色标管理
E. 按质量条款

正确答案：D。实行色标管理

解析：本题考查《药品经营质量管理规范》。在人工作业的库房储存药品，按质量状态实行色标管理（D对），合格药品为绿色，不合格药品为红色，待确定药品为黄色。